省级人民政府接到突发事件，应当向国务院卫生行政部门报告的时限
A. 1小时
B. 2小时
C. 6小时
D. 24小时
E. 立即

正确答案：A。1小时

解析：根据《突发公共卫生事件应急条例》规定，有下列情形之一的，省级人民政府应当在接到报告1小时（A对）内，向国务院卫生行政部门报告：发生或者可能发生传染病暴发、流行；发生或者发现不明原因的群体性疾病；发生传染病菌种、毒种丢失；发生或者可能发生重大食物和职业中毒事件。